疑为骨盆骨折的患者来院急诊，最首要的检查应是
A. X线片
B. MRI
C. 核素骨扫描
D. 肛门指诊
E. CT

正确答案：A。X线片

解析：疑为骨盆骨折的患者来院急诊，最首要的检查应是X线片（A对），X线检查可以显示骨折类型以及骨折移位情况，有助于明确诊断。MRI（B错）适用于软组织损伤的诊断，如脊髓。核素骨扫描（C错）多用于恶性肿瘤骨转移的诊断。肛门指诊（P383）（D错）主要用于肛管、直肠肿瘤等疾病的检查。CT（E错）用于X线不能发现或复杂部位的骨折，价格昂贵，一般不作为首选检查。